足三阳经的走向规律是
A. 从足走头
B. 从头走足
C. 从胸走手
D. 从手走头
E. 从足走腹

正确答案：B。从头走足

解析：十二经脉走行方向的规律：手三阴经起于胸中，循上肢内侧走向手指端（C错）；手三阳经起于手指端，循上肢外侧，走向头面部（D错）；足三阳经起于头面部，下行躯干循下肢外侧，走向足趾端（B对）；足三阴经起于足趾端，经下肢内侧走向腹部、胸部（E错）。